男婴，6个月。出生体重3.0kg，生后人工喂养，皮下脂肪消失，轻度水肿，精神萎靡，反应差，体温低，腹泻与便秘交替进行。患儿属于
A. 轻度营养不良水肿型
B. 轻度营养不良消瘦型
C. 重度营养不良水肿型
D. 重度营养不良消瘦型
E. 中度营养不良水肿型

正确答案：C。重度营养不良水肿型

解析：6个月男婴，皮下脂肪消失（皮下脂肪层厚度是判断营养不良程度的重要指标，提示重度营养不良），轻度水肿（提示水肿型），精神萎靡，反应差（提示重度营养不良），体温低，腹泻与便秘交替进行。结合该患儿的临床表现，可诊断为重度营养不良水肿型（C对ABE错）。营养不良消瘦型表现为肌肉松弛、萎缩呈“皮包骨”样（D错）。